通过内囊前肢的纤维束是
A. 额桥束
B. 皮质脊髓束
C. 丘脑皮质束
D. 皮质核束
E. 皮质红核束

正确答案：A。额桥束

解析：内囊前肢的投射纤维：主要包括额桥束（A对）和由丘脑背内侧核投射到前额叶的丘脑前辐射；内囊后肢的投射纤维：经豆丘部的下行纤维束为皮质脊髓束（B错）、皮质红核束（E错）和顶桥束等；内囊膝部的投射纤维有皮质核束（D错）；丘脑皮质束（E错）也为内囊后肢的投射纤维。